丹痧疹后伤阴证的治法是
A. 辛凉宜透，宣肺止咳
B. 养阴清热，清热利咽
C. 清气凉营，泻火解毒
D. 益气养阴，润肺止咳
E. 养阴生津，清热润喉

正确答案：E。养阴生津，清热润喉

解析：该题主要考查丹痧疹各证型的治法。丹痧疹临床以发热、咽喉肿痛或伴腐烂，全身布有弥漫性猩红色皮疹，疹后脱屑脱皮为特征。丹痧疹后伤阴证的治法是养阴生津，清热润喉（E对）。丹痧毒炽气营治法为清气凉营，泻火解毒（C错）。丹痧治法中无辛凉宜透，宣肺止咳（A错）、养阴清热清热利咽（B错）、益气养阴，润肺止咳（D错）。